朱砂配磁石的功效是
A. 滋阴潜阳
B. 重镇安神
C. 清心泻火
D. 解毒消肿
E. 纳气平喘

正确答案：B。重镇安神

解析：本题考查的是磁石与朱砂配伍。朱砂配磁石的功效是重镇安神（B对）。磁石：【功效】镇惊安神，平肝潜阳，聪耳明目，纳气平喘（E错）。【配伍】磁石配朱砂：磁石咸寒，功能潜阳安神；朱砂甘寒，功能镇心安神。两药相配，重镇安神力增，善治烦躁不安、心悸失眠等。龟甲：【功效】滋阴潜阳（A错），益肾健骨，养血补心，凉血止血。黄连：【功效】清热燥湿，泻火解毒。黄连长于清泻心火（C错）。金钱草：【功效】利水通淋，除湿退黄，解毒消肿（D错）。